在慢性病病因研究中，优先使用的频率指标是
A. 死亡率
B. 发病率
C. 患病率
D. DALY
E. YLD

正确答案：C。患病率